抑制远曲小管和近曲小管的碳酸酐酶是
A. 乙酰唑胺
B. 安体舒通
C. 氨苯蝶啶
D. 氢氯噻嗪
E. 呋喃苯胺酸

正确答案：A。乙酰唑胺

解析：本题考查利尿药。乙酰唑胺（A对）为碳酸酐酶抑制剂。通过抑制远曲小管和近曲小管的碳酸酐酶，降低细胞内氢离子的产生，使H⁺-Na⁺交换减少，增加水和碳酸盐的排出而产生利尿作用。安体舒通（B错）（螺内酯）结构与醛固酮相似，为醛固酮的竞争性抑制剂。氨苯蝶啶（C错）作用于远曲小管和集合管，直接抑制钠离子选择性通道。氢氯噻嗪（D错）抑制远曲小管上皮细胞对钠离子的重吸收产生中等强度的利尿作用。呋喃苯胺酸（呋塞米）（E错）主要作用于髓袢升支粗段。